提示胎盘功能低下的情况是
A. 孕妇尿雌激素/肌酐比值明显增加
B. 孕妇尿雌三醇明显增高
C. 孕妇胎盘生乳素明显增加
D. OCT阳性
E. NST反应型

正确答案：D。OCT阳性

解析：缩宫素激惹试验（OCT）用于产前监护及引产时胎盘功能的评价，若多次反复出现胎心晚期减速，则提示胎盘功能减退。妊娠36周后尿中雌三醇（E3）排出量（B错）降低，提示胎盘功能减退（P415）。妊娠35周后多次测定血清胎盘生乳素（C错）降低，提示胎盘功能减退（P418）。NST反应（无应激实验）异常提示胎盘功能异常，胎儿缺氧，NST反应型（E错）为正常型NST，胎盘功能正常，胎儿不缺氧。